不是肺脓肿手术指征的是
A. 急性肺脓肿
B. 反复大咯血
C. 支气管胸膜瘘
D. 合并支气管扩张者
E. 内科积极治疗无效的慢性肺脓肿

正确答案：A。急性肺脓肿

解析：对于急性肺脓肿应首选抗生素治疗6～8周（A错，为本题正确答案）。肺脓肿手术的适应证为：①肺脓肿病程超过3个月，经内科治疗脓腔不缩小（E对），或脓腔过大（5cm以上）估计不易闭合者；②大咯血经内科治疗无效（B对）或危及生命；③伴有支气管胸膜瘘（C错）或脓胸经抽吸、引流和冲洗疗效不佳者；④支气管阻塞限制了气道引流，如肺癌。对于合并支气管扩张症（D对）等基础疾病者，也应积极手术治疗。